对于同一种化学物，在相同的条件下，下列哪项毒性指标数值最小
A. LD₅₀
B. LD₀
C. LD₀₁
D. LD₁₀₀

正确答案：B。LD₀

解析：本题考查数值最小的毒性指标。LD₀即最大耐受剂量，指毒物不引起受试对象出现死亡的最大剂量。对于同一种化学物，在相同的条件下，LD₀（B对ACD错）数值最小。